30岁男性患者，病程4个月。头痛发病入院前出现左侧肢体无力和呕吐，入院查体：意识清，眼底视乳头水肿，左上下肢肌力Ⅳ级，腱反射活跃，病理征（+）。诊断是
A. 脑梗死
B. 脑出血
C. 蛛网膜下腔出血
D. 脑水肿
E. 颅内高压

正确答案：E。颅内高压

解析：患者中年男性，病程4个月，有头痛、呕吐、眼底视乳头水肿等典型的颅内高压表现，有脑组织受压而出现的左上下肢肌力Ⅳ级，腱反射活跃，病理征（+）等大脑皮质运动神经元受损倾向，应诊断为颅内高压（E对）。脑梗死（A错）和脑出血（B错）起病均较急，发病后病情会在较短时间内达到高峰而不会持续4个月。蛛网膜下腔出血（C错）起病突然，头痛剧烈，有典型的脑膜刺激征（P194）。脑水肿（D错）也引起颅内高压，导致上述临床表现，因而颅内高压是最佳选项。